我国规定水质处理器的成型材料和过滤材料需经浸泡试验合格后才可使用，浸泡试验不包括下列哪项指标
A. 一般化学指标
B. 毒理学指标
C. 感官性状指标
D. 微生物性状指标
E. 放射性指标

正确答案：E。放射性指标

解析：本题考查水质处理器的成型材料和过滤材料的浸泡试验。浸泡试验是一种常用的水质处理器材料评价方法，它可以检测材料的耐腐蚀性、耐热性、耐压性、耐磨性等性能指标。浸泡试验的主要内容是将材料放入指定的溶液中，在一定的时间内，观察材料的变化情况，以此来评价材料的性能。浸泡试验的指标主要包括一般化学指标（A对）、毒理学指标（B对）、感官性状指标（C对）、微生物性状指标（D对）等。一般化学指标是指材料中的元素成分，毒理学指标是指材料对人体健康的影响，感官性状是指材料的外观、质地、气味等，微生物性状指标是指材料中的微生物种类和数量。而放射性指标（E错，为本题正确答案）是指材料中的放射性元素，它不属于浸泡试验的指标范畴。